对于输尿管结石引起梗阻而致的肾功能明显受损，应釆取的措施是
A. 肾盂造瘘
B. 膀胱造瘘
C. 立刻使用利尿剂
D. 立刻中药排石
E. 输尿管切开取石

正确答案：E。输尿管切开取石

解析：输尿管切开取石术（E对）适用于：输尿管结石合并感染经治疗无效，或合并 肾盂积水，严重威胁肾功能者。